可以预防心身疾病的措施不包括
A. 养成健康的行为习惯和生活方式
B. 减少负性情绪对健康的不良影响
C. 正确认识各种生活事件
D. 多参加社会活动
E. 劳逸结合不超负荷工作

正确答案：D。多参加社会活动

解析：本题考查预防心身疾病的措施。多参加社会活动不属于（D错，为本题的正确答案）预防心身疾病的措施。可以预防心身疾病的措施包括养成健康的行为习惯和生活方式（A对）、减少负性情绪对健康的不良影响（B对）、正确认识各种生活事件（C对）、劳逸结合不超负荷工作（E对）。